目前测定中药中重金属及有害元素（铅、镉、汞、铜、砷）最常用的方法是
A. 紫外-可见分光光度法
B. 红外分光光度法
C. 原子吸收分光光度法
D. 薄层色谱扫描法
E. 高效液相色谱法

正确答案：C。原子吸收分光光度法

解析：本题考查的是原子吸收分光光度法。目前测定中药中重金属及有害元素（铅、镉、汞、铜、砷）最常用的方法是原子吸收分光光度法（C对）。铅、镉、砷、汞、铜测定：《中国药典》采用原子吸收分光光度法（第一法）或电感耦合等离子体质谱法（第二法）测定中药中铅、镉、砷、汞、铜的含量。紫外-可见分光光度法（A错）对主成分或有效成分在200～760nm处有最大吸收波长的中药，常可选用此法。测定样品时，所用溶剂在所测定波长附近应无吸收，不得有干扰吸收峰。红外分光光度法（B错）是鉴别化合物和确定物质结构的常用手段之一。在药物分析中，以红外光谱具有的“指纹”特性作为药物鉴定的依据，是各国药典共同采用的方法，但通常仅限于西药等单组分、单纯化合物的鉴定。高效液相色谱法（E错）系采用高压输液泵将规定的流动相泵入装有填充剂的色谱柱进行分离测定的色谱方法。